霍奇金病分期可根据以下何条件而明确
A. 骨髓检查发现Reed Stcmberg细胞
B. 异常的淋巴管造影
C. 胸腔积液
D. 脾大
E. 有全身症状

正确答案：D。脾大